一般在基础治疗结束后多久开始进行修复治疗
A. 1～2周
B. 2～3周
C. 4～6周
D. 6～7周
E. 6～8周

正确答案：E。6～8周

解析：本题考查牙周健康与修复。一般在基础治疗结束后6～8周（E对）开始进行修复治疗，牙周手术后则可能更长些。